脊神经后支说法,何者错误
A. 一般比前支细短
B. 分布于肌肉和皮肤
C. 为混合性神经
D. 均不形成神经丛
E. 除1、2颈神经前支外,均比前支粗大

正确答案：E。除1、2颈神经前支外,均比前支粗大

解析：脊神经后支均比前支细小（E错，为本题正确选项）。